男，56岁。皮肤黄染1个月，逐渐加重，伴有皮肤瘙痒，大便灰白色，无发热，查体：T36.8℃.P85次／分，R18次／分，BP130/80mmHg，巩膜皮肤黄染，双肺呼吸音清，未闻及干湿啰音，心律齐，腹软，肝肋下4cm，未触及胆囊，墨菲征（－），腹部CT:肝总管上段2cm-1.5cm占位病变。最适宜的术式是
A. 肝门部管、胆囊、部分肝外胆管及部分肝门区的肝组织切除
B. 全胰腺切除术
C. ERCP取石术
D. 胰头十二指肠切除术
E. 左三叶肝切除

正确答案：A。肝门部管、胆囊、部分肝外胆管及部分肝门区的肝组织切除

解析：本例患者为中年男性，主要表现为皮肤黏膜黄染、大便灰白色，为梗阻性黄疸的特点，合并有肝大（正常约为肋下1cm）但无腹痛、未触及胆囊且墨菲征（－），加之腹部CT检查结果可排除胆囊结石，考虑上段胆管癌，即肝门部胆管癌，因此在术试选择中，最适宜的为肝门部管、胆囊、部分肝外胆管及部分肝门区的肝组织切除（A对）。全胰腺切除术（B错）慢性胰腺炎是手术治疗之一，ERCP取石术（C错）为肝外胆石症的检查及手术治疗方式之一，胰头十二指肠切除术（D错）为下段胆管癌的手术治疗术式，肝左三叶切除（E错）为胆管癌扩大根治术，目前其实际意义尚存在争议，非最适宜的术式。